预防手术后感染的最重要的措施是
A. 提高机体抵抗力
B. 术前、术中、术后大量应用抗生素
C. 避免休克发生
D. 术后早期离床活动
E. 严格遵守无菌操作的原则

正确答案：E。严格遵守无菌操作的原则

解析：本题考查外科感染。无菌操作（E对）是预防术后感染的基础。